下列引起白细胞减少的疾病，发病机制不属于粒细胞破坏或消耗的是
A. 脾功能亢进
B. 类风湿关节炎
C. 系统性红斑狼疮
D. 巨幼细胞贫血
E. 败血症

正确答案：D。巨幼细胞贫血

解析：粒细胞破坏或消耗过多包括1.免疫性因素（1）药物；（2）自身免疫：如系统性红斑狼疮（C对）、类风湿关节炎（B对）等。2.非免疫性因素（1）消耗增多：重症感染（E对）时，中性粒细胞在血液或炎症部位消耗增多；（2）脾功能亢进（A对）。巨幼细胞贫血（D错，为本题正确选项）为缺乏维生素B12或叶酸导致的粒细胞成熟障碍，大量未成熟细胞原位破坏，生成减少。